属于职业特征的是
A. 建筑工人的腰背痛
B. 高空坠物致工人脚外伤
C. 长期站立工作者的下肢静脉曲张
D. 纺织工人的噪声性耳聋
E. 搬运工人的脚胼胝

正确答案：E。搬运工人的脚胼胝